在轻度铅中毒的基础上具有下列哪项表现者，可诊断为中度中毒
A. 铅麻痹
B. 铅脑病
C. 血铅升高
D. 尿ALA增高
E. 腹绞痛

正确答案：E。腹绞痛